可用寒因寒用法治疗的症候是
A. 实寒证
B. 虚寒证
C. 真热假寒
D. 真寒假热证
E. 寒热错杂证

正确答案：C。真热假寒

解析：用寒因寒用治则的证型，当表现为寒象，但却用寒凉药，说明该证型，表象为寒，实质为热，为真热假寒（C对）；实寒证治则当以热治寒（A错）；虚寒证治则为虚则补之（B错）；真寒假热证治则为热因热用（D错）；寒热错杂证治则为寒热并用（E错）。